热原性质不包括
A. 具有耐热性
B. 具有滤过性
C. 具有挥发性
D. 具有水溶性
E. 具有被氧化性

正确答案：C。具有挥发性

解析：本题考查热原的性质。热原性质不包括具有挥发性（C错，为本题正确答案）。热原的性质是不挥发性。热源的性质有：1.耐热性（A对）；2.滤过性（B对）；3.吸附性；4.水溶性（D对）；5.不挥发性；6.其他：热原能被强酸、强碱和强氧化剂所破坏（E对）。